互相尊重、密切合作、互相学习是
A. 处理医患关系的原则
B. 处理医际关系的原则
C. 处理医师与医师关系的原则
D. 处理医师与护士关系的原则
E. 处理医师与医技人员关系的原则

正确答案：B。处理医际关系的原则